关于湿疮的诊断依据，描述错误的是
A. 急性、亚急性损害呈多形性
B. 慢性湿疹呈局限性，皮肤增厚
C. 急性发作时，有明显诱因
D. 部位不定，对称分布
E. 急、慢性湿疹多伴有瘙痒

正确答案：C。急性发作时，有明显诱因

解析：急性湿疮起病较快，皮损常为对称性、原发性和多形性（常有红斑、潮红、丘疹、丘疱疹、水疱、脓疱、流滋、结痂并存）；亚急性湿疮皮损较急性湿疮轻，以丘疹、结痂、鳞屑为主，仅有少量水疱及轻度糜烂（A对）。慢性湿疮皮损多局限于某一部位，表现为皮肤肥厚粗糙（B对），触之较硬，色暗红或紫褐，皮纹显著或呈苔藓样变。湿疮其临床特点是皮损对称分布，部位不定（D对），多形损害，剧烈瘙痒（E对），有渗出倾向，反复发作，易成慢性等（C错，为本题正确答案）。